致使食品发生腐败变质的主要微生物是
A. 细菌
B. 真菌
C. 酵母
D. 病毒
E. 寄生虫

正确答案：A。细菌